大量使用碳酸酐酶抑制剂
A. 酸中毒时酸性尿
B. 反常性碱性尿
C. 碱中毒时碱性尿
D. 反常性酸性尿
E. 酸碱平衡时酸性尿

正确答案：B。反常性碱性尿

解析：应用碳酸酐酶抑制剂可抑制肾小管上皮细胞内碳酸酐酶活性，导致泌H+和重吸收HC03-减少，尿液PH上升，出现反常性碱性尿（B对）。